胆囊动脉最多来源于
A. 肝总动脉
B. 肝固有动脉
C. 胃十二指肠动脉
D. 腹腔干
E. 肝右动脉

正确答案：E。肝右动脉

解析：胆囊动脉常有变异，典型的胆囊动脉是指该动脉起源于腹腔动脉系统的肝右动脉，在肝总管的深面处发出，行经胆囊三角，达胆囊的左缘处分为深、浅两支，浅支分布于胆囊的游离面，深支分布于胆囊的肝床面，此种典型的关系见于约2/3的人。所以，胆囊动脉最多来源于肝右动脉（E对）。